口腔临床试验的基本分类不包括
A. 历史性对照研究
B. 病例对照研究
C. 随机对照试验
D. 交叉设计临床试验
E. 序贯临床试验

正确答案：B。病例对照研究

解析：临床试验的基本分类：①历史性对照研究。②非随机同期对照试验。③随机对照试验。④交叉设计临床试验。⑤序贯临床试验。掌握“口腔临床试验方法”知识点。